肺栓塞引起的血流动力学
A. 肺血管通透性增加
B. 肺通气功能障碍
C. 动静脉血管分流
D. 肺通气血流比例失调
E. 弥散障碍

正确答案：D。肺通气血流比例失调

解析：肺栓塞是以各种栓子阻塞肺动脉或其分支为其发病原因的一组疾病或临床综合征的总称，其引起的血流动力学改变通常为肺通气血流比例失调，是由于栓塞部位肺血流减少，肺泡无效腔量增大，肺内血流重新分布，最终导致肺通气血流比例失调（D对）；肺血管通透性增加（A错）常见于急性呼吸窘迫综合征；肺通气功能障碍（B错）包括限制性通气不足和阻塞性通气不足，限制性通气不足多出现于肺间质纤维化、胸廓畸形、胸腔积液、胸膜增厚或肺切除术后等疾病，阻塞性通气不足常见于慢性阻塞性肺疾；动静脉血管分流（C错），由于肺动脉内的静脉血未经氧合直接流入肺静脉，导致PaO₂降低，常见于肺动-静脉瘘；氧弥散障碍（E错），指O₂、CO₂等气体通过肺泡膜进行交换的物理弥散过程发生障碍，常为I型呼吸衰竭的主要机制。